接受内侧丘系纤维的丘脑神经核是
A. 腹后内侧核
B. 腹后外侧核
C. 腹外侧核
D. 腹前核
E. 无

正确答案：B。腹后外侧核

解析：腹后外侧核（B对）接受内侧丘系和脊髓丘系的纤维；腹后内侧核（A错）接受三叉丘系和由孤束核发出的纤维；腹前核（D错）和腹外侧核（C错），主要接受小脑齿状核、苍白球和黑质传入纤维。